接触化合物的途径不同，其毒性大小的顺序正确的是
A. 静脉注射﹤经呼吸道
B. 静脉注射﹥腹腔注射
C. 腹腔注射﹤经口
D. 经口﹤经皮
E. 皮下注射﹤皮内注射

正确答案：B。静脉注射﹥腹腔注射